载脂蛋白分类
A. TG、C、CE、磷脂和游高脂肪酸
B. A、B、C、D与E
C. Ⅰ、ⅡA、ⅡB、Ⅲ、Ⅳ和Ⅴ
D. CM、HDL、LDL、VLDL
E. 乙酰CoA

正确答案：B。A、B、C、D与E